1948年世界医学会颁布了全世界医务人员道德行为准则，它的基础是
A. 南丁格尔格言
B. 夏威夷宣言
C. 苏联医师宣言
D. 东京宣言
E. 希波克拉底誓言

正确答案：E。希波克拉底誓言

解析：1948年，世界医学会全体大会在日内瓦召开，与会者认为，希波克拉底誓言提出的总的医德精神应加以尊重，但应依据医学发展情况对其加以修订。于是，会议通过了《日内瓦宣言》。以《希波克拉底誓言》为蓝本的《日内瓦宣言》成为国际医学伦理权威文献，具有极强的规范、指导和激励作用，在全球医学界和医学伦理学界都有重要影响（E对）。